外源化学物主要与何种血浆蛋白质发生可逆结合
A. 白蛋白
B. α₁球蛋白
C. α₂球蛋白
D. β球蛋白
E. γ球蛋白

正确答案：A。白蛋白